流行性腮腺炎的中医病因是
A. 风热时邪
B. 时行疫气
C. 时行邪毒
D. 风温邪毒
E. 暑热时邪

正确答案：D。风温邪毒

解析：流行性腮腺炎是由腮腺炎病毒所引起的急性呼吸道传染病，本病的中医病机为感受风温时邪，从口鼻而入，侵犯足少阳胆经，邪毒壅阻于足少阳经脉，与气血相搏，凝结于耳下腮部所致（D对）。